在确定急性上消化道出血的原因时不合适的检查是
A. 急诊胃镜
B. 急诊X线钡剂造影检查
C. 血常规
D. 肝、肾功能检查
E. 腹部B超

正确答案：B。急诊X线钡剂造影检查

解析：急性上消化道出血不宜使用X线钡剂造影检查（B错，为本题正确答案），应于出血停止数天后进行。急诊胃镜（A对）可用于明确出血的部位并于内镜下止血，为急性消化道出血的首选检查及治疗方法。血常规（C对）可用于评估贫血的程度及是否有活动性出血，以指导临床治疗。肝、肾功能检查（D对）有一定的临床意义。当循环血量降低时，可引起肾前性氮质血症，大量长期失血肾小管坏死可引起肾性氮质血症，肝、肾功能检查有助于诊断。腹部B超可用于了解肝、胆、胰病变，对诊断胆道出血具有重要意义。